发热的消退期可出现
A. 产热正常，散热减少
B. 产热增多，散热减少
C. 产热与散热都增多
D. 产热减少，散热减少
E. 产热减少，散热增多

正确答案：E。产热减少，散热增多

解析：经历了高温持续期后，由于激活物、EP及发热介质的消除，体温调节中枢的调定点返回到正常水平，体温开始下降，此时产热减少，散热增多（E对）。产热增多，散热减少（B错）是体温上升期的热代谢特点。产热与散热都增多（C错）是高温持续期的热代谢特点。在发热过程的三个时期中一般没有A、D选项的相关说法。